人体试验的道德原则，下列除外哪项均正确
A. 严谨的医学态度
B. 符合医学目的
C. 受试者知情同意
D. 医学发展至上
E. 维护受试者利益

正确答案：D。医学发展至上

解析：人体实验的道德原则即基本伦理准则包括：①人体实验必须具有正当的目的（B对）；②人体实验必须合理维护受试者利益（E对），这一准则是人体实验的核心性伦理准则，而不是唯医学发展至上（D错，为本题正确答案）；③人体实验必须经过受试者知情同意（C对）；④人体实验必须恪守严谨的学风（A对）。